骨折引起脂肪栓塞是由于
A. 病人肥胖
B. 脂肪肝
C. 骨筋膜室压力过高
D. 脂肪滴进入静脉窦
E. 静脉压力增高

正确答案：D。脂肪滴进入静脉窦

解析：骨折引起脂肪栓塞的机制大致有两种：一种是由于骨折处髓腔内血肿张力过大，骨髓被破坏，脂肪滴进入破裂的静脉窦内，引起脂肪栓塞（D对），使正常血液中的乳糜微粒失去乳化稳定性，结合成直径达10～20μm的脂肪球而成为栓子，阻塞毛细血管。骨折病人均有发生脂肪栓塞的可能，与病人的胖瘦无关（A错）。脂肪肝（B错）（九版内科学P391）是以肝细胞脂肪过度贮积和脂肪变性为特征的临床病理综合症，脂肪蓄积于肝细胞内，不会引起血管的栓塞。骨筋膜室是由骨、骨间膜、肌间隔和深筋膜形成，压力过高（C错）可导致骨筋膜室综合征，引起骨筋膜室内肌肉和神经因急性缺血而产生的一系列综合症，与脂肪栓塞关系不大。静脉压力增高（E错）会导致血液回流障碍，反而不易引起脂肪栓塞。